小儿肥胖应限制饮食，但下列哪项是不正确的
A. 快速进食
B. 克服偏食
C. 睡前不进食
D. 早餐合理
E. 不吃零食

正确答案：A。快速进食

解析：快速进食不利于营养吸收和消化，还会导致肥胖加剧（A错，为本题正确答案）；小儿肥胖者多因后天过食肥甘，因此应限制饮食，养成良好的饮食习惯，定时定量进餐，不偏食等（BCDE对）。